一定时期内（一般以年为单位）某病患者中因该病死亡的比例
A. 发病率
B. 死亡率
C. 罹患率
D. 病死率
E. 患病率

正确答案：D。病死率